以下不属于牙髓切断术适应证的是
A. 外伤冠折露髓的年轻恒牙
B. 深龋去腐尽，露髓孔≤0．5mm的年轻恒牙
C. 局限性牙髓炎的成熟恒牙
D. 意外露髓的年轻恒牙
E. 以上都不对

正确答案：C。局限性牙髓炎的成熟恒牙

解析：本题考查牙髓切断术的适应证。局限性露髓的成熟恒牙应采取根管治疗术，而非牙髓切断术（C错，为本题的正确答案）。外伤冠折露髓（A对）、深龋去腐尽，露髓孔≤0.5mm（B对）、意外露髓（D对）的年轻恒牙可用冠髓切断术。直接盖髓术的适应证：机械性或外伤性露髓，意外露髓，露髓孔小于 lmm。